支气管哮喘病人呼气比吸气更为困难，其原因是
A. 吸气是被动的，呼气是主动的
B. 吸气时肺弹性阻力减小，呼气时肺弹性阻力增大
C. 吸气时胸廓弹性阻力减小，呼气时胸廓弹性阻力增大
D. 吸气时气道阻力减小，呼气时气道阻力增大
E. 吸气时胸内负压减小，呼气时胸内负压增大

正确答案：D。吸气时气道阻力减小，呼气时气道阻力增大

解析：肺通气阻力可分为弹性阻力（占70%）和非弹性阻力（30%）两类，其中气道阻力又占非弹性阻力的70%～80%，由于气道阻力又与其管道半径4次方成反比，因此气道管径大小是影响气道阻力的主要因素。吸气时，因胸膜腔内负压增大而跨壁压增大，因肺的扩展而使弹性成分对小气道的牵引作用增强，以及交感神经紧张性活动增强等，都使气道口径增大，气道阻力减小；呼气时则相反，气道口径变小，气道阻力增大。因此，支气管哮喘病人呼气比吸气更为困难，其原因是吸气时气道阻力减小，呼气时气道阻力增大（D对）。